引起黄变米的病原物质是
A. 黄曲霉毒素
B. T-2毒素
C. 岛青霉素
D. 丁烯酸内酯
E. 脱氧雪腐镰刀菌烯醇

正确答案：C。岛青霉素

解析：本题考查引起黄变米的病原物质。引起黄变米的病原物质是岛青霉素（C对ABDE错）。